属非噻唑烷二酮类胰岛素增敏剂的药物是
A. 瑞格列奈
B. 格列本脲
C. 罗格列酮
D. 二甲双胍
E. 阿卡波糖

正确答案：D。二甲双胍

解析：本题考查胰岛素分泌促进剂。二甲双胍（D对）属于非噻唑烷二酮类胰岛素增敏剂。瑞格列奈（A错）、格列本脲（B错）均为胰岛素分泌促进剂。罗格列酮（C错）属于噻唑烷二酮类胰岛素增敏剂。阿卡波糖（E错）属于α-葡萄糖苷酶抑制剂。